RDA是指
A. 适宜摄入量
B. 估计平均需求量
C. 生理需要量
D. 推荐营养素供给量
E. 可耐受最高摄入量

正确答案：D。推荐营养素供给量